以下对医疗机构从业人员行为规范表述不正确的是
A. 遵纪守法，依法执业
B. 优质服务，医患和谐
C. 以医疗为中心，全心全意为人民健康服务
D. 尊重患者的知情同意权和隐私权
E. 不索取和非法收受患者财物

正确答案：C。以医疗为中心，全心全意为人民健康服务

解析：医疗机构从业人员基本行为规范：以人为本，践行宗旨；遵纪守法，依法执业；尊重患者，关爱生命；优质服务，医患和谐；廉洁自律，恪守医德；严谨求实，精益求精；爱岗敬业，团结协作；乐于奉献，热心公益（C错，为本题正确答案）。